女性，30岁。月经量多已二年，近三个月来感乏力、头晕、心悸，查血红蛋白65g/L，白细胞6.0×10⁹/L，血小板140×10⁹/L，骨髓象：粒比红为1：1，红细胞增生活跃，中晚幼红细胞45%，体积小，胞浆偏蓝，治疗首选
A. 肌注维生素B₁₂
B. 口服铁剂
C. 输血
D. 脾切除
E. 口服叶酸

正确答案：B。口服铁剂

解析：患者育龄女性，有月经过多史（缺铁的原发病表现），出现乏力、头晕、心悸（贫血的表现），血红蛋白65g/L（成年女性正常值Hb＞110g/L），提示贫血；骨髓象：红细胞增生活跃，中晚幼红细胞45％，体积小，胞浆偏蓝（符合缺铁性贫血的骨髓象特点），综合考虑最可能的诊断是缺铁性贫血，缺铁性贫血的治疗原则是：根除病因；补足贮铁。故治疗首选的是口服铁剂（B对）。肌注维生素B₁₂（A错）、口服叶酸（E错）主要用于治疗巨幼细胞贫血（P546）；输血（C错）指征是Hb＜60g/L；脾切除（P554）（E错）是遗传性球形细胞增多症首选的治疗方法。